妊娠恶阻，口淡，呕吐清涎者，多为
A. 脾胃虚弱
B. 肝胃不和
C. 脾虚痰湿
D. 肝郁脾虚
E. 肝经湿热

正确答案：A。脾胃虚弱

解析：素体脾胃虚弱，升降失常，受孕后血聚子宫以养胎，子宫内实，冲脉之气较盛，冲脉起于胞宫隶于阳明，冲气循经上逆犯胃，胃失和降，反随冲气上逆而发为恶阻；脾胃虚弱，运化失司，水湿内停随胃气上行，或湿聚成痰，故口淡，呕吐清涎（A对）。妊娠恶阻一般根据其主证呕吐的特点，即呕吐物的颜色、气味、性状进行分析，呕吐物夹有痰涎，伴中脘痞满，舌苔厚腻，为脾虚痰湿（C错）；呕吐物酸苦，伴口干、舌苔黄腻，为肝胃不和（B错）。